患儿，男性，5岁。近1年来双侧腮腺反复肿胀，消炎有效，近1个月发作频繁。如诊断明确为儿童复发性腮腺炎，以下哪种治疗不宜实行
A. 嘱多喝水
B. 按摩腮腺腺体帮助排唾
C. 给予氯己定漱口液含漱
D. 全身抗感染治疗
E. 待炎症稳定后行腮腺腺体摘除术

正确答案：E。待炎症稳定后行腮腺腺体摘除术

解析：本题考查复发性腮腺炎的治疗。儿童复发性腮腺炎有自愈性，大多数在青春期前不再发作，无需行腮腺腺体摘除术（E错，为本题的正确答案）。治疗儿童复发性腮腺炎可嘱患者嘱多喝水（A对），每天按摩腮腺腺体帮助排唾（B对），用淡盐水漱口，保持口腔卫生，也可给予氯己定漱口液含漱（C对），若有急性炎症表现，可用抗生素进行全身抗感染治疗（D对）。